某女性患者，38岁。牙龈自发性出血1年半就诊。检查：舌缘、两颊黏膜多处瘀斑，患者自述平时轻微碰撞皮肤即会出现瘀斑。血常规检查：血小板计数30×10⁹/L。下列哪种措施也可用于治疗该病
A. 脾切除
B. 免疫增强剂
C. 补充铁剂
D. 维生素B、叶酸
E. 维生素C

正确答案：A。脾切除

解析：本题考查血小板减少性紫癜的治疗。某女性患者，38岁。牙龈自发性出血1年半就诊。检查：舌缘、两颊黏膜多处瘀斑，患者自述平时轻微碰撞皮肤即会出现瘀斑。血常规检查：血小板计数30×10⁹/L，考虑诊断为血小板减少性紫癜，也可用于治疗该病的措施为脾切除（A对）。免疫增强剂（B错）是指单独或同时与抗原使用时能增强机体免疫应答的物质，主要用于免疫缺陷病、慢性感染性疾病，也常作为肿瘤的辅助治疗药物。补充铁剂（C错）常用于治疗缺铁性贫血。维生素B、叶酸（D错）常用来治疗巨幼细胞性贫血。维生素C（E错）具有增强机体免疫力的作用，临床上可用于心血管疾病、感染性疾病等的支持性治疗。